具有预防和逆转血管平滑肌增厚及左心室肥厚的抗高血压药物是
A. 利尿剂
B. 钙通道阻滞剂
C. 血管紧张素转换酶抑制剂
D. β肾上腺素受体阻断剂
E. α肾上腺素受体阻断剂

正确答案：C。血管紧张素转换酶抑制剂

解析：本题考查血管紧张素转化酶抑制剂。血管紧张素转化酶抑制剂（C对）（ACEI）能够改善左心室功能，降低心脏充盈压，增加每搏输出量，增加左心室射血分数和心脏指数，可延缓血管壁和心室壁肥厚。利尿剂（A错）通过排钠利尿，降低血容量，从而降低血压。钙通道阻滞剂（B错）适用于老年高血压。β受体阻断剂（D错）能够减少心排出量，降低血压。α受体阻断剂（E错）可与其它药物联合用于顽固性高血压。